尿路感染的中医病机不包括
A. 肺气失宣
B. 气滞血瘀
C. 膀胱湿热
D. 脾肾亏虚，湿热屡犯
E. 肾阴不足，湿热留恋

正确答案：A。肺气失宣

解析：尿路感染的主要与湿热毒邪蕴结膀胱及相关脏腑功能失调有关，具体可由膀胱湿热（C对）邪气壅滞，气化失司，水道不利所致；或由情志不遂，气郁化火或气滞血瘀（B对）致膀胱气化不利；或脾肾亏虚，湿热屡犯（D对）发为劳淋；或肾阴不足，湿热留恋（E对）膀胱气化不利故呈虚实夹杂之侯。尿路感染病位在肾与膀胱，与肝、脾关系密切（A错，为本题正确答案）。